男性，60岁。阑尾切除术后第6天起上腹隐痛，伴发热、寒战，体温高达39.5℃，无腹泻。右下胸叩痛，呼吸音减弱；腹稍胀，右上腹压痛，腹肌软，未及肿块，肠鸣音不亢进。最可能的诊断是
A. 右侧肺炎
B. 右侧肺不张
C. 膈下脓肿
D. 盆腔脓肿
E. 小肠梗阻

正确答案：C。膈下脓肿

解析：老年男性患者，阑尾切除术后出现上腹痛，伴发热、寒战（提示感染），无腹泻，右下胸叩痛，呼吸音减弱（提示病变位于右下胸部），腹软，未及肿块，肠鸣音不亢进（可排除肠梗阻），结合患者病史和体查，最可能的诊断为右侧膈下脓肿（C对）。阑尾切除术后，病人多处于平卧位，此时膈下部位最低，腹腔内的脓液易积聚于此处形成膈下脓肿，常表现为肋缘下或剑突下钝痛，深呼吸时加重，膈下感染可出现咳嗽、胸痛等胸膜、肺反应。肺炎（A错）临床主要症状为发热、咳嗽、咳痰，可伴胸痛或呼吸困难等。肺不张（B错）主要是由于肿瘤、肉芽肿或异物等阻塞支气管腔所致，以呼吸系统症状为主要表现，可有胸闷、气急、呼吸困难、干咳等，合并感染后可有患侧胸痛。盆腔脓肿（P334）（D错）多表现为下腰部下坠不适感，可出现尿频、便频、里急后重等膀胱和直肠刺激症状，查体可有下腹部深压痛，直肠指诊可触及向直肠内膨出的肿块，有明显压痛。小肠梗阻（E错）主要表现为腹痛、腹胀、呕吐和停止自肛门排气排便，查体可见肠型和蠕动波，多有肠鸣音亢进。